某化学物可引起实验动物癌症，在小鼠骨髓微核试验得到阳性结果，但仅当加入S9混合物时才在Ames试验得到阳性结果。说明此化学物为
A. 促长剂
B. 终致癌物
C. 间接致癌物
D. 非遗传毒性致癌物
E. 辅致癌物

正确答案：C。间接致癌物